已用于中药制剂研究或生产的新技术有
A. 固体分散技术
B. β-环糊精包合技术
C. 指纹图谱质量控制技术
D. 超临界流体萃取技术
E. 大孔树脂吸附分离精制技术

正确答案：A、B。固体分散技术；β-环糊精包合技术

解析：本题考查的是中药制剂的新技术。已用于中药制剂研究或生产的新技术有固体分散技术（A对）与β-环糊精包合技术（B对）。固体分散体技术：固体分散体是指药物与载体混合制成的高度分散的固体分散物。制备成固体分散体的技术称为固体分散技术。环糊精包合物技术：指将药物分子包藏于环糊精分子空穴结构内形成环糊精包合物的技术。指纹图谱质量控制技术（C错）：中药指纹图谱系指中药原料药材、饮片、半成品、成品等经适当处理后，采用一定的分析手段，得到的能够标示其特征的共有峰的图谱，能客观地揭示和反映中药内在质量的整体性和特征性，用以评价中药的真实性、有效性、稳定性和一致性。超临界流体萃取技术（D错）：是采用超临界流体为溶剂对中药材进行萃取的方法。CO₂为最常用的超临界流体物质。大孔吸附树脂技术（E错）：大孔吸附树脂具有选择性吸附和分子筛的性能。它的吸附性是由于范德华引力或产生氢键的结果，分子筛的性能是由其本身的多孔性网状结构决定的。大孔吸附树脂现在已被广泛应用于天然化合物的分离和富集工作中。